既治风寒表实无汗，又治风寒表虚有汗的药物是
A. 麻黄
B. 紫苏
C. 桂枝
D. 香薷
E. 荆芥

正确答案：C。桂枝

解析：该题考查解表药的适应证，麻黄用于风寒表实无汗证（A错）。紫苏用于风寒感冒兼气滞证（B错）。桂枝用于风寒表实无汗证和风寒表虚有汗证（C对）。香薷用于风寒感冒兼有湿者（D错）。荆芥用于外感表证，祛风功效强（E错）。